脾经的郄穴是
A. 外丘
B. 粱丘
C. 中都
D. 地机
E. 金门

正确答案：D。地机

解析：该题考查十六经脉的郄穴。地机是脾经的郄穴（D对）。外丘是胆经的郄穴（A错）。梁丘是胃经的郄穴（B错）。中都是肝经的郄穴（C错）。金门是膀胱经的郄穴（E错）。